若牙周袋较浅，牙槽骨的外形尚佳，做龈下刮治使牙周袋变浅即可，此种做法适合哪种程度的根分叉病变
A. Ⅰ度病变
B. Ⅱ度病变
C. Ⅲ度病变
D. Ⅳ度病变
E. Ⅴ度病变

正确答案：A。Ⅰ度病变

解析：Ⅰ度病变：若牙周袋较浅，牙槽骨的外形尚佳，做龈下刮治使牙周袋变浅即可。若袋较深，牙槽骨不符合生理外形，应在基础治疗后，行翻瓣手术消除牙周袋和修整骨外形，以利于菌斑控制。掌握“根分叉病变”知识点。